患者，女，32岁，已婚。曾孕4次均自然流产，平日头晕眼花，心悸气短，现又妊娠32天，面色苍白，舌淡苔白，脉细弱。治疗应首选
A. 补肾固冲丸
B. 补肾安胎饮
C. 泰山磐石散
D. 加味阿胶汤
E. 以上均非

正确答案：C。泰山磐石散

解析：患者孕四次均自然流产，是为滑胎，平素头晕眼花，心悸气短，是气血虚弱之象，现妊娠32天，并伴有面色苍白，舌淡苔白，脉细弱血虚之象，治疗要用泰山磐石散益气养血，固冲安胎（C对E错）。补肾固冲丸功效补气健脾，益肾安胎，治脾肾两虚之证（A错）。补肾安胎饮功效固肾安胎，主肾虚胎动不安证（B错）。加味阿胶汤补肾益阳，温煦水液，治疗肾虚小便多等肾虚之证（D错）。